患儿，1岁。发热，咳嗽，喘憋2天，经治疗后病情未见好转，傍晚突然面色苍白，口唇发紫，四肢厥冷，按之右胁下痞块迅速增大。其证候是
A. 气滞血瘀
B. 热毒内闭
C. 邪陷心肝
D. 肝风内动
E. 心阳虚衰

正确答案：E。心阳虚衰

解析：心阳虚损为肺炎喘嗽的变证。正不胜邪，气滞血瘀加重，可致心失所养，心气不足，甚而心阳虚衰，并使肝脏藏血失调，临床出现呼吸不利、或喘促息微、颜面唇甲发绀、胁下痞块迅速增大，四肢厥冷。本患儿符合心阳虚衰的证候（E对）。气滞血瘀为心阳虚衰变证产生的重要病理机制（A错）。热毒内闭可见壮热烦躁，神昏谵语等（B错）。邪陷心肝可见四肢抽搐，口噤项强，双目上视，舌质红绛，指纹青紫，可达命关，或透关射甲（C错）。肝风内动可见四肢抽搐，口噤项强，双目上视等（D错）。